应用肿瘤疫苗对肿瘤进行预防的方法
A. 主动免疫治疗
B. 被动免疫治疗
C. 非特异性免疫治疗
D. 特异性免疫治疗
E. 以上说法均正确

正确答案：A。主动免疫治疗

解析：肿瘤的主动免疫是应用肿瘤疫苗对肿瘤进行预防或治疗的方法。掌握“肿瘤免疫”知识点。